男，40岁。左肾盂结石1.5cm，静脉尿路造影显示左肾功能正常，逆行肾盂造影证实左侧肾盂输尿管交界处狭窄，首选治疗方法是
A. 服用药物排石
B. 开放手术取石+肾盂输尿管成形
C. 体外冲击波碎石
D. 经皮肾镜碎石
E. 大量饮水

正确答案：B。开放手术取石+肾盂输尿管成形

解析：患者左肾盂1.5cm结石，左侧肾盂输尿管交界处狭窄，应首选开放手术取出结石，同时行输尿管成形（B对），以改善肾盂输尿管交界处的狭窄症状。药物排石（A错）、大量饮水（E错）主要用于直径＜0.6cm、表面光滑、结石以下尿路无梗阻的患者。体外冲击波碎石（C错）、经皮肾镜碎石（D错）均要求结石以下尿路通畅，该患者有肾盂输尿管交界处狭窄，碎石易导致狭窄处梗阻，故不适用。